下列操作，属于提插泻法的是
A. 先浅后深
B. 轻插重提
C. 提插幅度小
D. 频率慢
E. 操作时间短

正确答案：B。轻插重提

解析：提插补泻：针下得气后，先浅后深（A错），重插轻提，提插幅度小（C错），频率慢（D错），操作时间短（E错）者为补法；得气后，先深后浅，轻插重提（B对），以上提力量为主的为泻法。